患者，男，60岁。3年前诊断为急性广泛性前壁心肌梗死，现喘促气逆，不能平卧，夜间尤甚，心悸不寐，咳痰清稀，量多，形寒肢冷，腰膝酸软，小便不利，舌淡暗苔白腻，脉弦细而滑。治疗应首选
A. 真武汤合五苓散
B. 真武汤合苓桂术甘汤
C. 真武汤合桃红四物汤
D. 参附汤合五苓散
E. 参附汤合葶苈大枣泻肺汤

正确答案：E。参附汤合葶苈大枣泻肺汤

解析：阳气虚衰，胸阳不振，气机痹阻，血行瘀滞，水湿犯肺，故见气逆，不能平卧，夜间尤甚，心悸不寐，咳痰清稀，量多；阳虚不能温煦，故见形寒肢冷，腰膝酸软；舌淡暗苔白腻，脉弦细而滑，均为阳虚水泛之证候，故可诊断为阳虚水泛证，治疗需温阳利水，通脉止痛，方药选用参附汤合葶苈大枣泻肺汤加减（E对）。五苓散（AD错）、苓桂术甘汤（B错）泻肺水作用不是很强，真武汤合桃红四物汤（C错）治疗阳虚水停，水瘀互结证。